溃疡的定义为
A. 上皮表层坏死或脱落
B. 上皮浅层坏死或脱落
C. 上皮及上皮下坏死或脱落
D. 上皮下坏死或脱落
E. 以上都不是

正确答案：A。上皮表层坏死或脱落

解析：本题考查口腔黏膜基本病理变化。溃疡的定义为上皮表层坏死或脱落（A对）。黏膜或皮肤表层坏死而脱落形成凹陷为溃疡。按其破坏组织的程度，可分为浅层溃疡和深层溃疡。浅层溃疡只破坏上皮层，愈合后不留瘢痕，如复发性阿弗他溃疡。而深层溃疡则波及黏膜下层，痊愈后遗留瘢痕，如复发性坏死性黏膜腺周围炎。糜烂是黏膜的一种表浅缺损，为上皮的部分损伤，不损及基底细胞层。掌握“口腔黏膜基本病理变化”知识点。